主动脉瓣狭窄患者最重要的体征是主动脉瓣区
A. 收缩期喷射性杂音
B. 收缩期叹气样杂音
C. 舒张期喷射性杂音
D. 舒张期隆隆样杂音
E. 舒张期叹气样杂音

正确答案：A。收缩期喷射性杂音

解析：主动脉瓣狭窄时，为了对抗瓣膜部梗阻病变，左心室排送血液入主动脉时必须加强收缩力，延长收缩期时限，致左心室腔压力升高，左心室与主动脉收缩压呈现压力阶差。收缩期血流会加速通过狭窄瓣膜，在升主动脉内血液形成涡流而产生收缩期喷射性杂音（A对BC错）。舒张期隆隆样杂音（D错）常见于二尖瓣狭窄。舒张期叹气样杂音（E错）常见于主动脉瓣关闭不全。